《药品生产监督管理办法》的内容包括
A. 开办药品生产企业的申请与审批
B. 医疗机构制剂配制的申请与审批
C. 药品生产许可证管理
D. 药品委托生产管理
E. 监督检查

正确答案：A、C、D、E。开办药品生产企业的申请与审批；药品生产许可证管理；药品委托生产管理；监督检查